《中华人民共和国执业医师法》第二十二条规定的医师的法律义务同时也是其基本的道德义务，这些义务应除外的是
A. 遵守法律，法规、技术操作规范
B. 树立敬业精神，遵守职业道德，履行医师职责，尽职尽责为患者服务
C. 维护医院形象，关心医院创收，积极推进公立医院营利性、市场化改革
D. 关心、爱护、尊重患者，保护患者的隐私
E. 努力钻研业务，更新知识，提高专业技术水平

正确答案：C。维护医院形象，关心医院创收，积极推进公立医院营利性、市场化改革